可作片剂崩解剂使用的辅料的是
A. CMC-Na
B. CMS-Na
C. PEG4000
D. HPC
E. PVP

正确答案：B。CMS-Na

解析：本题考查片剂的常用辅料。崩解剂系指促使片剂在胃肠液中迅速破裂成细小颗粒的辅料。常用的崩解剂有：干淀粉、羧甲基淀粉钠（CMS-Na）（B对）、低取代羟丙基纤维素、交联羧甲基纤维素钠（CCMC-Na）、交联聚维酮（PVPP）和泡腾崩解剂（碳酸氢钠和枸橼酸组成的混合物，也可以用柠檬酸、富马酸与碳酸钠、碳酸钾、碳酸氢钾）等。CMC-Na（羧甲基纤维素钠）（A错）、HPC（羟丙基纤维素）（D错）、PVP（聚维酮）（E错）均为黏合剂；PEG4000（聚乙二醇类）（C错）为润滑剂。